宜用中火炒制的是
A. 芥子
B. 牛蒡子
C. 苍耳子
D. 莱菔子
E. 荆芥

正确答案：C。苍耳子

解析：本题考查的是苍耳子的炮制方法。宜用中火炒制的是苍耳子（C对）。苍耳子：【炮制方法】处方用名有苍耳子、炒苍耳子。①苍耳子：取原药材，除去杂质，用时捣碎。②炒苍耳子：取净苍耳子，置炒制容器内，用中火加热，炒至黄褐色，刺焦时即可，碾去刺，筛净。用时捣碎。芥子（A错）：【炮制方法】处方用名有芥子、白芥子、炒芥子、炒白芥子。①芥子：取原材料，去净杂质，用时捣碎。②炒芥子：取净芥子，置炒制容器内，用文火加热，炒至淡黄色至深黄色（炒白芥子）或深黄色至棕褐色（炒黄芥子），有爆鸣声，断面浅黄色，有香辣气时即可。用时捣碎。牛蒡子（B错）：【炮制方法】处方用名有牛蒡子、大力子、炒牛蒡子、炒大力子。①牛蒡子：取原药材，除去杂质，洗净，干燥。用时捣碎。②炒牛蒡子：取净牛蒡子，置炒制容器内，用文火加热，炒至略鼓起，微有香气，断面浅色时，取出。用时捣碎。莱菔子（D错）：【炮制方法】处方用名有莱菔子、萝卜子、炒莱菔子。①莱菔子：取原药材，去净杂质，洗净，干燥。用时捣碎。②炒莱菔子：取净莱菔子，置炒制容器内，用文火加热，炒至微鼓起，质酥脆，断面浅黄色，有香气逸出即可。用时捣碎。荆芥（E错）：【炮制方法】处方用名有荆芥、荆芥炭。①荆芥：取原药材，除去杂质，抢水洗净，稍润，切断，干燥，筛去碎屑。②炒荆芥：取荆芥段，置炒药锅内，用文火加热，炒至微黄色，取出，放凉。③荆芥炭：取荆芥段，置炒药锅内，用武火加热，炒至表面黑褐色，内部焦褐色时，喷淋少量清水，灭尽火星。取出，晾干凉透。